年老肾虚，大便秘结，小便清长，头目眩晕，腰膝酸软。治疗应选用
A. 肾气丸
B. 济川煎
C. 真武汤
D. 地黄饮子
E. 六味地黄丸

正确答案：B。济川煎

解析：肾司气化而主二便之开合，肾阳虚弱，气化失司，津液不布，肠失濡润，传导不利，故大便秘结，小便清长；腰为肾之府，肾主骨生髓，肾虚精亏，髓海失充，故头目眩晕，腰膝酸软。故用济川煎温肾益精，润肠通便（B对）。肾气丸（A错）的功用为补肾助阳，化生肾气。主治：肾阳气不足证。真武汤（C错）的功用为温阳利水。主治：阳虚水泛证。地黄饮子（D错）的功用为滋肾阴，补肾阳，开窍化痰。主治：喑痱。六味地黄丸（E错）的功用为填精滋阴补肾。主治：肾阴精不足证。